预防细菌性食物中毒主要应抓好以下哪个环节
A. 预防细菌污染食品
B. 加强对广大群众的宣传
C. 控制细菌在食品中的繁殖及产毒
D. 彻底加热杀灭病菌、破坏毒素
E. 以上都是

正确答案：E。以上都是